以下哪点不是病人的义务
A. 如实提供病情和有关信息
B. 避免将疾病传播他人
C. 尊重医师和他们的劳动
D. 不可以拒绝医学科研试验
E. 在医师指导下对治疗作出负责的决定并与医师合作执行

正确答案：D。不可以拒绝医学科研试验

解析：在医疗活动中，患者应履行的道德义务主要有：①配合医者诊疗的义务；②遵守医院规章制度；③给付医疗费用的义务；④保持和恢复健康的义务；⑤支持临床实习和医学发展的义务。掌握“医患关系伦理”知识点。